《处方管理办法》规定，药学专业技术人员调剂处方时必须做到“四查十对”，对临床诊断属于
A. 查处方
B. 查药品
C. 査配伍禁忌
D. 査用药合理性
E. 查医生的签名

正确答案：D。査用药合理性

解析：本题考查的是“四查十对”原则。《处方管理办法》规定，药学专业技术人员调剂处方时必须做到“四查十对”，对临床诊断属于査用药合理性（D对）。“四查十对”原则：药师调剂处方时必须做到“四查十对”：查处方（A错），对科别、姓名、年龄；查药品（B错），对药名、剂型、规格、数量；查配伍禁忌（C错），对药品性状、用法用量；查用药合理性，对临床诊断。